下列关于肺炎链球菌叙述错误的是
A. 革兰氏染色为阳性
B. 矛头状成双排列
C. 有鞭毛，不形成芽胞
D. 有些毒株可形成荚膜
E. 在血琼脂培养基平板上形成α-溶血环

正确答案：C。有鞭毛，不形成芽胞

解析：肺炎链球菌：革兰氏染色为阳性，矛头状成双排列，无鞭毛，不形成芽胞，有些毒株可形成荚膜，在血琼脂培养基平板上形成α-溶血环。掌握“链球菌属”知识点。